男，12岁，患再生障碍性贫血半年，因重度贫血，需要反复输血。应输注的血液成分是
A. 洗涤红细胞
B. 去除白细胞的红细胞
C. 悬浮红细胞
D. 浓缩红细胞
E. 冰冻红细胞

正确答案：B。去除白细胞的红细胞

解析：青少年男性患者，患再生障碍性贫血半年，因重度贫血，需要反复输血。应输注的血液成分是去除白细胞的红细胞（B对）。洗涤红细胞（A错）适用于对白细胞凝集素有发热反应者及肾功能不全不能耐受库存血中之高钾者。悬浮红细胞（C错）适用于急性贫血或慢性贫血。浓缩红细胞（D错）适用于各种急慢性失血，慢性贫血及心功能不全者输血。冰冻红细胞（E错）适用于①同洗涤红细胞；②自身红细胞的储存。